排除无芽胞厌氧菌的依据是
A. 机体多个部位的脓疡
B. 血性分泌物，恶臭或有气体
C. 分泌物直接涂片可见细菌
D. 在普通肉汤培养基中呈表面生长
E. 在血平板中长出微小菌落

正确答案：D。在普通肉汤培养基中呈表面生长